颌面部包扎使用的绷带的长和宽分别是
A. 5m、10～12cm
B. 5m、8～10cm
C. 8m、8～10cm
D. 8m、5～8cm
E. 10m、8～15cm

正确答案：B。5m、8～10cm

解析：本题考查口外创口处理。绷带的应用最为广泛和简便，可适用于各种部位创口的包扎，颌面部常用宽8～10cm、长5m（B对）左右的绷带。